女，46岁。因白带多半年，性交后出血1周就诊，宫颈刮片病理：宫颈鳞癌，浸润深度肉眼见癌灶最大直径≤4cm。患者临床分期属于
A. ⅠA₂期
B. ⅠB₁期
C. ⅠB₂期
D. ⅡA期
E. ⅡB期

正确答案：C。ⅠB₂期

解析：该患者为中年女性，出现接触性出血，宫颈刮片病理：宫颈鳞癌，肉眼见癌灶最大直径≤4cm，诊断为子宫颈癌，按照FIGO2009标准，正确临床分期为ⅠB2期（C对）。